临床上测定基础代谢率，主要用来判断哪个器官的功能
A. 甲状腺
B. 肾上腺
C. 胰腺
D. 心脏
E. 肝脏

正确答案：A。甲状腺